除另有规定外，外用散剂应通过
A. 一号筛
B. 二号筛
C. 六号筛
D. 七号筛
E. 九号筛

正确答案：D。七号筛